通过生理过程的自然吞噬使药物选择性地浓集于病变部位的靶向制剂称为
A. 被动靶向制剂
B. 主动靶向制剂
C. 物理靶向制剂
D. 化学靶向制剂
E. 物理化学靶向制剂

正确答案：A。被动靶向制剂

解析：本题考查靶向制剂。被动靶向制剂（A对）系利用药物载体，使药物被生理过程自然吞噬而实现靶向的制剂。主动靶向制剂（B错）是用修饰的药物载体作为“导弹”，将药物定向地运送到靶区浓集发挥药效的药物制剂。物理化学靶向制剂（CDE错） 系应用某些物理化学方法使靶向制剂在特定部位发挥药效。